慢性唇炎的病因是
A. 干燥气候
B. 舔唇咬唇不良习惯
C. 烟酒、烫食嗜好
D. 化学、机械刺激
E. 病因不明

正确答案：E。病因不明

解析：本题考查慢性唇炎的病因。慢性唇炎又称慢性非特异性唇炎，病因不明（E对）。可能与温度、化学、机械（D错）性因素的长期持续性刺激有关，例如气候干燥（A错）、风吹、烟酒和烫食的刺激（C错）、舔唇咬唇的不良习惯等，也可能与精神因素有关。